治疗心绞痛气虚血瘀证应首选
A. 当归四逆汤
B. 血府逐瘀汤
C. 瓜蒌薤白半夏汤
D. 天王补心丹
E. 补阳还五汤

正确答案：E。补阳还五汤

解析：心绞痛气虚血瘀证机理为气虚无力推动血行，淤血内停，脉络不通，不通则痛，故其治法为益气活血，通脉止痛，代表方为益气活血，通脉止痛的补阳还五汤加减（E对）。当归四逆汤（A错）功用为温经散寒，养血通脉，多用来治疗血虚寒凝经脉证；血府逐瘀汤（B错）功用为活血化瘀，通脉止痛，多用于治疗心血瘀阻证；瓜蒌薤白半夏汤可（C错）功用为通阳泄浊，豁痰开痹，多用于治疗痰浊内阻证；天王补心丹（D错）功用为补心宁神，滋阴清热，多用于治疗阴亏内热，心神不宁证。